纠正休克所致组织低灌注和缺氧的关键措施是
A. 应用血管活性药物
B. 补充血容量
C. 积极处理原发病
D. 高浓度吸氧
E. 纠正酸中毒

正确答案：B。补充血容量

解析：纠正休克引起的组织低灌注和缺氧的关键措施是补充血容量（B对）。应用血管活性药物（A错）在充分容量复苏的前提下进行，以维持脏器灌注压。积极处理原发病（C错）在恢复有效循环血量的情况下，有时也在积极抗休克的同时进行，处理原发病变，才能有效地治疗休克。高浓度吸氧（D错）适用于通气血流比例失调、分流、弥散障碍、CO中毒，有严重缺氧而不伴有二氧化碳潴留的病人。纠正酸中毒（E错）不主张早期进行，因碱中毒使血红蛋白氧离曲线左移，氧不易从血红蛋白释出，可使组织缺氧加重；而酸性环境有利千氧与血红蛋白解离，从而增加组织供氧。